与位置觉无关的结构是
A. 球囊斑
B. 螺旋器
C. 椭圆囊斑
D. 位听神经
E. 壶腹嵴

正确答案：B。螺旋器

解析：球囊斑（A错）和椭圆囊斑（C错）属位觉感受器，感受头部静止的位置及直线变速运动引起的刺激。壶腹峭（E错）是位觉感受器，能感受头部旋转变速运动的刺激。螺旋器（B对）是听觉感受器。